女28岁，妊娠29周。反复无痛阴道流血3次，且每次出血量逐渐增多。超声诊断为前置胎盘。此患者最可能的类型是
A. 前置性
B. 完全性
C. 部分性
D. 边缘性
E. 低置性

正确答案：B。完全性

解析：青年孕妇，从妊娠29周（完全性前置胎盘初次出血时间多在妊娠28周左右，称为“警戒性出血”）起反复3次阴道流血，且每次出血量逐渐增多，根据患者的临床表现，最可能的类型是完全性前置胎盘（B对E错），无前置性前置胎盘的说法（A错）。部分性前置胎盘（C错）的初次出血时间、出血量及反复出血次数，介于完全性前置胎盘与边缘性前置胎盘之间。边缘性前置胎盘（D错）出血多发生在妊娠晚期或临产后，出血量较少。